女，64岁。拟行直肠癌根治术。2型糖尿病病史20余年。现每日皮下注射胰岛素，平素晨起应用胰岛素12U。空腹血糖常为7～10mmol/L，尿糖（+～++）。下列围手术期处理不恰当的是
A. 手术当日测定空腹血糖
B. 必须将空腹血糖控制到正常水平
C. 术前应用葡萄糖及胰岛素
D. 尿糖可维持原水平
E. 手术日晨停用胰岛素

正确答案：B。必须将空腹血糖控制到正常水平

解析：患者老年女性，根据题意可知患者拟施行直肠癌根治术，且患者患有2型糖尿病20余年，每日皮下注射胰岛素治疗。现患者空腹血糖为7～10mmol/L（空腹正常值为3.9～6.1mmol/L），尿糖（+～++）。直肠癌根治术术前需肠道准备，严格控制饮食及血糖，但无需控制在正常范围（B错，为本题正确答案），尿糖维持原水平（+～++）（D对），患者应于手术当日测定空腹血糖（A对）以了解血糖情况，以避免因胰岛素过多而发生低血糖，也可避免因胰岛素过少而发生酸中毒。因患者平日皮下注射胰岛素治疗，故患者术前应以葡萄糖和胰岛素维持正常糖代谢（C对），且在手术日晨停用胰岛素（E对）。